激动阿片受体的药物是
A. 扑米酮
B. 司来吉兰
C. 可待因
D. 多奈哌齐
E. 加巴喷丁

正确答案：C。可待因

解析：本题考查激动阿片受体的药物。可待因（C对）为弱的阿片类受体激动药；扑米酮（A错）作用于GABA受体发挥抗癫痫作用；司来吉兰（B错）是选择性单胺氧化酶抑制剂；多奈哌齐（D错）是乙酰胆碱脂酶抑制剂；加巴喷丁（E错）是是GABA氨基转移酶抑制剂。